恶性黑色素瘤的发生与下列哪项因素有关
A. 损伤
B. 慢性刺激
C. 内分泌因素
D. 营养因素
E. 以上均有关

正确答案：E。以上均有关

解析：损伤、慢性刺激、不恰当的治疗均常为恶性黑色素瘤发生的原因。此外与内分泌和营养因素也有关，例如，在青春期前很少发生恶性黑色素瘤；妊娠期中肿瘤发展较快。因此，早期处理颜面皮肤痣及口腔内黏膜黑斑是预防恶性黑色素瘤最有效的措施。掌握“恶性黑色素瘤”知识点。